某患者78岁，女，牙列缺失十五年，牙槽嵴严重吸收，修复宜选用哪种人工牙
A. 解剖式牙
B. 半解剖式牙
C. 非解剖式牙
D. 金属（牙合）面牙
E. 瓷牙

正确答案：C。非解剖式牙

解析：本题考查全口义齿排牙人工牙的选择。一般根据牙槽嵴宽窄和高低来选择后牙的牙尖高低和颊舌径宽窄。患者牙槽嵴大面积吸收，应选择非解剖式牙（C对）。非解剖式牙为无尖牙（0°牙），无高出（牙合）面的牙尖，（牙合）面间是平面接触，以减小侧向力，使（牙合）力主要以垂直方向向牙槽嵴传导，可减少由侧向力造成的义齿不稳定，适用于牙槽嵴条件较差的患者。解剖式牙（A错）牙尖斜度较大，咀嚼运动时侧向力大，不适用于义齿固位差或对颌牙已有明显磨损的患者。半解剖式牙（B错）比解剖式牙牙尖斜度略低，但咀嚼时仍有一定侧向力，不适用于牙槽嵴条件太差的患者。金属（牙合）面牙（D错）难以调磨，适用于缺牙间隙过下，（牙合）龈距过低等，一般不用于全口义齿。瓷牙（E错）脆性大，易折，咬合冲击力大，不适合牙槽嵴严重吸收的全口义齿。